某小学有大批的学生发生不明原因的腹泻，为了寻找病因及流行的线索，首先应进行的研究是
A. 病例对照研究
B. 队列研究
C. 临床试验研究
D. 理论流行病学研究
E. 现况调查研究

正确答案：E。现况调查研究

解析：现况调查研究收集的是大批学生发生腹泻的时间、学生中腹泻的状况及有关因素的资料，并对资料的分布特征加以描述（E对），可以得到大批学生发生不明原因的腹泻的病因及流行的线索，所以首先应进行的研究是现况调查研究。病例对照研究是用于判断暴露因素是否与研究的疾病有关联及其关联程度大小（A错），不适合寻找大批学生发生不明原因的腹泻的病因及流行的线索。队列研究是判定暴露因素与结局之间有无关联及关联程度大小（B错），不适合寻找大批学生发生不明原因的腹泻的病因及流行的线索。临床试验用于评价药物或治疗方法的效果（C错）。理论流行病学用于客观定量地描述疾病流行状况或预测疾病流行趋势，从理论上探讨疾病的流行规律和防制措施的效果（D错），不能用于寻找某小学有大批的学生发生不明原因的腹泻的病因及流行的线索。